急性根尖周炎最常见的典型自然排脓途径
A. 根尖孔→根管→髓腔
B. 根尖周→骨膜下→黏膜下
C. 根尖周→骨膜下→皮肤下
D. 根尖周→牙周间隙→龈沟
E. 根尖周→骨髓腔→上颌窦

正确答案：B。根尖周→骨膜下→黏膜下

解析：根尖周→骨膜下→黏膜下，此排脓方式是急性根尖周炎最常见的典型自然发展过程。这种排脓途径较复杂，并常伴发颌面部蜂窝组织炎。掌握“急性根尖周炎”知识点。